血栓闭塞性脉管炎查体的特异性体征是
A. 足背动脉搏动消失
B. Homans征阳性
C. Trendelenburg试验阳性
D. Perthes试验阳性
E. Burger试验阳性

正确答案：E。Burger试验阳性

解析：足背动脉消失可见于足背动脉的损伤或脉管炎，无特异性（A错）。Homans征（直腿伸踝试验）阳性提示小腿深静脉血栓形成（B错）。Trenderlenburg试验阳性提示大隐静脉瓣膜功能不全（C错）。Perthes试验（深静脉通畅试验）阳性用于检查深静脉是否通畅，表示深静脉阻塞，为大隐静脉高位结扎的禁忌证（D错）。 Burger实验（肢体抬高试验）常用于诊断血栓闭塞性脉管炎（E对）。